COPD气道炎症最主要的效应细胞是
A. 肥大细胞
B. 嗜酸性粒细胞
C. 中性粒细胞
D. 巨噬细胞
E. 淋巴细胞

正确答案：C。中性粒细胞

解析：COPD气道炎症最主要的效应细胞是中性粒细胞（C对），通过释放中性粒细胞弹性蛋白酶等多种生物活性物质引起慢性黏液高分泌状态并破坏肺实质。肥大细胞（A错）、嗜酸性粒细胞（B错）、淋巴细胞（E错）在呼吸道疾病中与支气管哮喘有关（P28）。巨噬细胞（D错）也参与COPD气道炎症，但不是最重要的效应细胞。